下列面色中，湿热熏蒸的面色为
A. 黄如烟熏
B. 黄而色苍
C. 黄而鲜明
D. 淡黄浮肿
E. 淡黄消瘦

正确答案：C。黄而鲜明

解析：湿热蕴蒸肝胆，胆热外泄，外渗肌肤，下流膀胱，而致一身面目及小便尽黄，且黄色鲜明如橘子色，小便色深如浓茶，伴随食欲减退或恶心呕吐，大便不畅等（C对）。黄而晦暗如烟熏者，称为阴黄，多因寒湿困阻而成（A错）。面色青黄，即面色青黄相兼，又称苍黄，多属肝郁脾虚、血瘀水停，可见于鼓胀或胁下癥积的患者（B错）。面色黄而浮肿，称为黄胖，属脾虚湿蕴（D错）。面色淡黄消痩，见于脾胃虚衰（E错）。